受MHC限制的是
A. CTL杀伤病毒感染细胞
B. NK细胞杀伤肿瘤细胞
C. 巨噬细胞吞噬细菌
D. 抗体结合病毒
E. 树突状细胞摄取抗原

正确答案：A。CTL杀伤病毒感染细胞